化学物的一般急性毒性试验，如无特殊要求，则动物性别选择为
A. 雌雄多少都可以
B. 雌雄各半
C. 全部为雄性
D. 全部为雌性

正确答案：B。雌雄各半

解析：本题考查急性毒性试验的动物性别选择。化学物的一般急性毒性试验，如无特殊要求，则动物性别选择为雌雄各半（B对ACD错）。